长期用药可引起全身红斑狼疮样综合征的药物是
A. 奎尼丁
B. 普鲁卡因胺
C. 利多卡因
D. 胺碘酮
E. 维拉帕米

正确答案：B。普鲁卡因胺